治疗鼓胀水湿困脾证，应首选
A. 柴胡疏肝散合胃苓汤
B. 实脾饮
C. 中满分消丸
D. 调营饮
E. 附子理苓汤

正确答案：B。实脾饮

解析：鼓胀气滞湿阻证治宜疏肝理气，运脾利湿，方选柴胡疏肝散合胃苓汤（A错）。鼓胀水湿困脾证的病机是湿邪困遏，脾阳不振，寒水内停。治宜温中健脾，行气利水，首选实脾饮（B对）。鼓胀水热蕴结证治宜清热利湿，攻下逐水，方选中满分消丸合茵陈蒿汤（C错）。鼓胀瘀结水留证治宜活血化瘀，行气利水，方选调营饮（D错）。鼓胀阳虚水盛证，治宜温补脾肾，化气利水，方选附子理苓汤或济生肾气丸（E错）。